硝苯地平需要检查的特殊杂质
A. 游离水杨酸
B. 酮体
C. 游离肼
D. 光降解产物
E. 二苯酮衍生物

正确答案：D。光降解产物

解析：本题考查特殊杂质的检查。硝苯地平需要检查的特殊杂质为光降解产物（D对）。